关于Ⅲ度烧伤，下列哪项是错误的
A. 痛觉丧失
B. 无水疱
C. 无栓塞状血管
D. 焦痂约3周后开始分离
E. 留有瘢痕

正确答案：C。无栓塞状血管

解析：Ⅲ°烧伤：使全皮层烧伤甚至达到皮下、肌肉或骨骼。创面无水疱，呈蜡白或焦黄色甚至炭化，痛觉消失，局部温度低，皮层凝固性坏死后形成焦痂，触之如皮革，痂下可显树枝状栓塞的血管。因皮肤及其附件已全部烧毁，无上皮再生的来源，必须靠植皮而愈合。掌握“火器伤、热烧伤”知识点。